菌斑百分率在多少以下时可认为菌斑被基本控制
A. 0.1
B. 0.2
C. 0.3
D. 0.4
E. 0.45

正确答案：B。0.2

解析：若菌斑百分率在20%以下，可认为菌斑基本上被控制；如果百分率为10%或小于10%，则已达到良好的目标。掌握“牙周病流行病学及分级预防”知识点。